对动脉血压波动性变化比较敏感的感受器位于
A. 颈动脉窦
B. 主动脉弓
C. 颈动脉体
D. 主动脉体
E. 心肺感受器

正确答案：A。颈动脉窦